某男，26岁。咳嗽3日，症见干咳、连声作呛、喉痒干痛、唇鼻干燥、痰少而黏、不易咯出、心烦口渴，舌红干而少津、苔薄白、脉浮数。证属风燥伤肺、肺失清润。治以疏风清肺、润燥止咳。处方：桑叶9g、薄荷3g、苦杏仁9g、南沙参9g、天花粉10g、浙贝母9g、芦根10g、前胡10g、炒牛蒡子10g、淡豆豉10g、桔梗5g，7剂，每日1剂，水煎服。方中能疏散风热、清肺润燥的中药是
A. 天花粉
B. 炒牛蒡子
C. 桔梗
D. 桑叶
E. 浙贝母

正确答案：D。桑叶

解析：本题考查桑叶的功效。方中能疏散风热、清肺润燥的中药是桑叶（D对）。桑叶【功效】疏散风热，清肺润燥，平肝明目，凉血止血。天花粉（A错）【功效】清热生津，清肺润燥，消肿排脓。炒牛蒡子（B错）【功效】疏散风热，宣肺利咽，解毒透疹，消肿疗疮。桔梗（C错）【功效】宣肺，利咽，祛痰，排脓。浙贝母（E错）【功效】清热化痰，散结消肿。